菊花疏散风热外，又能
A. 平肝明目
B. 息风止痉
C. 凉血止血
D. 祛风止痛
E. 疏肝、透疹

正确答案：A。平肝明目

解析：本题考查的是菊花的功效。菊花疏散风热外，又能平肝明目（A对）。菊花：【功效】疏散风热，平肝明目，清热解毒。蝉蜕：【功效】疏散风热，透疹止痒，明目退翳，息风止痉（B错）。桑叶：【功效】疏散风热，清肺润燥，平肝明目，凉血止血（C错）。蔓荆子：【功效】疏散风热，清利头目，祛风止痛（D错）。薄荷：【功效】宣散风热，清利头目，利咽，透疹，疏肝（E错）。